口服给药吸收缓慢且在肝内灭活，应该舌下含服的药物是
A. 氨茶碱
B. 硝酸甘油
C. 维生素K
D. 钙化三醇
E. 维生素C

正确答案：B。硝酸甘油